男，8个月。5天前出现发热，体温最高达38.3℃，伴流涕咳嗽，1天前出现热峰达39.6℃，咳嗽加剧且耳后及面部逐渐出现皮疹。查体：神智清，精神欠佳，耳后及颜面部散在红色充血性斑丘疹，睑结膜充血，颊黏膜可见较多灰白色小点，外有红晕，咽部充血，呼吸急促，双肺呼吸音粗可闻及细湿啰音，可诊断为
A. 风疹
B. 猩红热
C. 麻疹
D. 水痘
E. 急性荨麻疹

正确答案：C。麻疹

解析：婴幼儿，发热5天，最高达38.3℃，伴流涕咳嗽，1天前突然升高至39.6℃，咳嗽加剧且耳后及面部逐渐出现皮疹（符合麻疹的出疹特点），查体：神智清，精神欠佳，耳后及颜面部散在红色充血性斑丘疹，睑结膜充血，颊黏膜可见较多灰白色小点（麻疹的特异性体征），外有红晕，咽部充血，呼吸急促，双肺呼吸音粗可闻及细湿啰音（提示呼吸道感染），根据患儿的临床症状及体征，考虑最可能的诊断为麻疹）（C对），风疹（A错）临床症状轻，且伴有耳后、颈部淋巴结肿大并触痛，且在症状出现后1-2天出疹。猩红热（B错）伴有杨梅舌，环口苍白圈，颈部淋巴结肿大受累，丘疹是针尖大小，全身皮肤均可，出疹时高热，且在症状出现后1-2天出疹。水痘（D错）一般在发热后1-2天出疹，皮疹呈向心分布，有水泡，易溃破，且伴有瘙痒。荨麻疹（E错）属于药物疹，有原发病症状，有近期服药史。皮疹伴有瘙痒，摩擦及受压部位多。